男，31岁。车祸致枕部着地昏迷1小时。查体：P60次/分，R12次/分，BP170/90mmhg。右侧顶枕部头皮血肿，GSC评分7分，右侧瞳孔2mm，对痛觉刺激无反应。左侧瞳孔4mm，瞳孔对光反射消失。患者左侧额颞底部弥漫挫裂伤，血肿体积约60ml，致同侧脑室受压，中线向右移位15mm。可能的损伤机制是
A. 切线性损伤
B. 加速性损伤
C. 减速性损伤
D. 挥鞭伤
E. 挤压伤

正确答案：C。减速性损伤

解析：减速性损伤（C对）：运动着的头部突然撞于静止的物体所引起的损伤，称为减速性损伤，例如坠落或跌倒时头部被物体阻挡停止运动。此类损伤发生于着力部位，以及着力部位的对侧的脑组织和血管，即对冲伤。切线性损伤（A错）的特点是投射物呈切线性擦过伤员的头部而远逸，造成头皮软组织、颅骨、硬脑膜和脑组织的沟槽状损伤。加速性损伤（B错）：相对静止的头部突然遭受外力打击，头部沿外力作用方向呈加速运动而造成的损伤，称为加速性损伤，例如钝器击伤即属此类。这种方式造成的损伤主要发生在着力部位，即着力伤。头颅运动有如挥动鞭子末端的运动，造成颅颈交界处延髓与脊髓连接部的损伤，即挥鞭伤（D错）。挤压性损伤（E错）：两个或两个以上不同方向的外力同时作用于头部，颅骨变形造成的损伤，称为挤压性损伤。